公共场所新参加工作的从业人员上岗前应
A. 在卫生监督所备案
B. 经卫生行政部门同意
C. 取得卫生法律知识培训合格证明及健康合格证
D. 在街道办事处备案
E. 有过类似工作经历

正确答案：C。取得卫生法律知识培训合格证明及健康合格证

解析：本题考查公共场所新参加工作的从业人员上岗前的要求。公共场所新参加工作的从业人员上岗前应取得卫生法律知识培训合格证明及健康合格证（C对ABDE错）。